二次供水
A. 指由水源集中取水，经统一净化处理和清毒后，由输水管网送至用户的供水方式
B. 将来自集中式供水的管理水另行加压、贮存，再送至水站或用户的供水设施
C. 在饮用水生产和供水过程中与饮用水接触的塑料及有机合成管材，管件属于
D. 指从事净水，取样，化验，二次供水卫生管理及水池，水箱清洗人员
E. 负责本行政区域内饮用水污染事故对人体健康影响的调查

正确答案：B。将来自集中式供水的管理水另行加压、贮存，再送至水站或用户的供水设施